应激性溃疡的发生
A. 与交感肾上腺髓质系统兴奋有关
B. 与遗传易感性激活有关
C. 两者均是
D. 两者均否
E. 无

正确答案：A。与交感肾上腺髓质系统兴奋有关

解析：应激性溃疡的发生与交感肾上腺髓质系统兴奋有关（A对）。